患者，65岁。查体：桶状胸，心尖搏动出现在剑突下，且深吸气时增强，肺动脉瓣第二心音增强。应首先考虑的是
A. 冠心病
B. 高血压性心脏病
C. 风心病
D. 肺心病
E. 心肌炎

正确答案：D。肺心病